口服有效的AT₁受体拮抗药是
A. 卡托普利
B. 普萘洛尔
C. 哌唑嗪
D. 氯沙坦
E. 硝苯地平

正确答案：D。氯沙坦

解析：本题考查AT₁受体拮抗药。氯沙坦（D对）是口服有效的AT₁受体拮抗药，能够阻断血管紧张素Ⅱ与AT₁受体结合，降低血压，逆转心肌肥厚，减轻心力衰竭等。卡托普利（A错）为非肽类血管紧张素转化酶抑制剂，临床用于高血压、心力衰竭。普萘洛尔（B错）是β肾上腺素受体拮抗药，临床用于高血压、心绞痛、室上性快速心律失常、室性心律失常的等。哌唑嗪（C错）为选择性突触后α₁受体阻滞药，通过阻滞血管平滑肌突触后膜α₁受体，降低外周血管阻力，降低血压。硝苯地平（E错）为钙通道阻滞剂，临床用于高血压、冠心病、心绞痛。